温病辨证论治中身热夜甚，心烦躁扰，斑疹隐隐，舌红绛无苔，脉细数者。宜选择的方剂是
A. 栀子豉汤
B. 导赤承气汤
C. 清营汤
D. 清宫汤
E. 犀角地黄汤

正确答案：C。清营汤

解析：身热夜甚，斑疹隐隐，舌红绛无苔，脉细数，提示热深入营分，耗伤营阴，邪热传营，伏于阴分，入夜阳气又内归营阴，与热相合，故身热夜甚；营气通于心，热扰心营，故心烦躁扰；热入营血，伤及血络，血不循经，溢出脉外，故斑瘆隐隐；舌红绛无苔，脉细数，为热伤营阴之候。故当治以清营，透热，养阴，宜首选清营汤，以苦咸寒之犀角为君药，清解营分之热毒；臣以生地黄（凉血滋阴）、麦冬（清热养阴生津）、玄参（滋阴降火解毒），既可甘寒养阴保津，又可助君药清营凉血解毒；佐以银花、连翘、竹叶，轻清透泄，使营分热邪有外达之机，促其透出气分而解（C对）。栀子豉汤功用为清热除烦（A错）。导赤承气汤功用为清热、通腑（B错）。清宫汤功用为清心解毒，养阴生津（D错）。犀角地黄汤功用为清热解毒，凉血散瘀（E错）。